单因素方差分析的备择假设是
A. 各对比组样本方差不相等
B. 各对比组总体方差不相等
C. 各对比组样本均数不相等
D. 各对比组总体均数不相等
E. 各对比组总体均数不等或不全等

正确答案：E。各对比组总体均数不等或不全等